患者，男，60岁。患高血压多年。症见：眩晕，甚则闭目恶睁，视物旋转，如坐舟楫，头胀痛，间有手足抽搐，舌红苔薄黄少津，脉弦数。其治法是
A. 泻肝清火
B. 镇肝熄风
C. 滋阴平肝
D. 化痰祛湿
E. 滋阴补阳

正确答案：B。镇肝熄风

解析：肝阳暴亢，则见闭目恶睁，视物旋转，如坐舟楫，头胀痛，脉弦数。阳亢化风，夹痰夹火，窜走经隧，则见手足抽搐，舌红苔薄黄少津。故诊断为肝风上扰，治益镇肝熄风（B对）。泻肝清火法治疗肝火亢盛（A错）。滋阴平肝法治疗阴虚阳亢（C错）。化痰祛湿法治疗痰湿中阻（D错）。滋阴补阳法治疗阴阳两虚（E错）。